X线平片绝大多数能显影的结石是
A. 胆囊结石
B. 肝内胆管结石
C. 肝外胆管结石
D. 尿路结石
E. 胆总管结石

正确答案：D。尿路结石

解析：尿路结石以含钙结石最为常见，约90%的含钙结石可以在X线下显像，即X线平片绝大多数能显影的结石是尿路结石（D对）。胆囊结石（A错）、肝内胆管结石（B错）、肝外胆管结石（C错）（包括胆总管结石（E错））等胆道结石以胆固醇和胆色素为主要成分，钙盐含量较少，X线平片多不显影，首选超声检查。